治疗呃逆胃阴不足证，应首选
A. 沙参麦冬汤
B. 麦门冬汤
C. 益胃汤
D. 玉女煎
E. 一贯煎

正确答案：C。益胃汤

解析：益胃汤方中重用生地、麦冬，味甘性寒，功能养阴清热，生津润燥，为甘凉益胃之上品，共为君药。配伍北沙参、玉竹为臣，养阴生津，以加强生地、麦冬益胃养阴之力。冰糖濡养肺胃，调和诸药，为佐使。全方甘凉清润，清而不寒，润而不腻，药简力专，共奏养阴益胃之效。为胃阴不足的首选方（C对）。沙参麦冬汤，其功用为甘寒养阴，润燥生津，可用于内伤咳嗽之肺阴亏虚证（A错）。麦门冬汤，其功用为滋阴养胃，降逆止呕，可用于呕吐之胃阴不足证(B错)。玉女煎，其功用为清胃滋阴，可用于中消、胃热炽盛证（D错）。一贯煎，其功用为滋阴柔肝止痛，适用于胁痛之肝阴不足证，合芍药汤也可用于胃痛之胃阴不足证（E错）。